在生产或使用过程中，有机磷农药中毒的主要摄入途径是
A. 经皮肤
B. 经呼吸道
C. 经消化道
D. 经口腔黏膜
E. 经眼结膜

正确答案：A。经皮肤

解析：本题考查有机磷农药的吸收途径。有机磷农药可经胃肠道、呼吸道以及完好的皮肤或黏膜吸收。皮肤（A对BCDE错）吸收是急性职业性中毒的主要途径。吸收后迅速随血液及淋巴循环分布到全身各器官组织，其中以肝脏含量最高。具有氟、氰等基团的有机磷，可通过血脑屏障。有的还能通过胎盘屏障到达胎儿体内。脂溶性高的有机磷农药能少量储存于脂肪组织中延期释放。